若遇严重的不良反应，应立即
A. 进行洗胃
B. 进行透析
C. 同时禁食
D. 无须特殊处理
E. 采取对症治疗

正确答案：E。采取对症治疗